不符合公共浴池的卫生要求的是
A. 浴池水每日更换
B. 浴室内设公用脸巾、浴巾
C. 浴池水浊度不超过30度
D. 一天中还要补充新水2次
E. 每次补充新水的量不少于池水总量的20%

正确答案：B。浴室内设公用脸巾、浴巾

解析：本题考查公共浴池的卫生要求。公共浴池的卫生要求应符合：浴池水应每日更换（A对），且一天中还要补充新水2次（D对），每次补充新水的置应不少于池水总最的20%（E对），浴池水浊度不超过30度（C对）。浴室内不设公用脸巾、浴巾等（B错，为本题正确答案）。